下列有关氟摄入说法错误的是
A. 人体氟的主要来源是饮水
B. 空气中的氟会引起氟中毒
C. 食物中摄取的氟量不是恒定的
D. 成人饮水量每日约2500～3000ml
E. 水中氟不易被吸收

正确答案：E。水中氟不易被吸收

解析：人体氟的主要来源是饮水，约占人体氟来源的65%。虽然空气中的氟不是人体氟的主要来源，但在某些特殊环境条件下可引起空气氟污染，空气中的氟可以通过呼吸道进入人体，造成机体氟中毒。同一地区的不同种类的食品，不同地区的同类食品的氟含量都存在着一定的差异，故从食品中摄取的氟量不是恒定的。水中氟很容易被吸收。机体从饮水中摄入氟量的多少直接受到饮水氟浓度和饮水量的调控。饮水摄入量又与个体的年龄、生活习惯及当地的气温等因素有关，12岁以前的饮水量约占液体总摄入量的50%，成人饮水量每日约2500～3000ml。热带地区饮水量显著大于严寒地区。掌握“人体氟摄入及代谢、氟防龋”知识点。